女孩，17岁，阴道流血16天，量多，无性生活史，13岁初潮，月经不规则，查体:下腹部压痛明显，Hb54g/L，该患者治疗方式不包括
A. 减少月经量
B. 纠正贫血
C. 调理月经周期
D. 止血
E. 诊断性刮宫

正确答案：E。诊断性刮宫

解析：女孩，17岁（发病人群），阴道流血16天，量多，无性生活史，13岁初潮，月经不规则（无排卵AUB常见表现），查体：下腹部压痛明显，Hb54g/L（正常值：110-150g/L，提示重度贫血），结合患者的症状、体征、实验室检查，考虑诊断为无排卵性异常子宫出血。由于诊断性刮宫（E错，为本题正确答案）适用于年龄>35岁、药物治疗无效或存在子宫内膜癌高危因素的异常子宫出血患者，故其不适用于该患者的治疗。减少月经量（A对）、纠正贫血（B对）、调理月经周期（C对）、止血（D对）是无排卵AUB常规治疗措施。